患儿，4岁。晨起喷嚏，流涕，继而发热，体温38.1℃，精神倦怠，晚间头面、躯干见稀疏细小皮疹，疹色淡红。治疗应首选
A. 银翘散
B. 葱豉汤
C. 桑菊饮
D. 杏苏散
E. 清营汤

正确答案：A。银翘散

解析：患儿喷嚏，流涕，轻度发热、全身皮肤出现稀疏细小皮疹，当属风疹，疹色淡红，证属邪犯肺卫，其肺主皮毛，属卫司表，时邪自口鼻而入，与气血相搏，正邪相争，外泄于肌肤，则见风疹，治宜银翘散，可疏风散热解表（A对）。葱豉汤适于风寒感冒轻证（B错）。桑菊饮适于风热犯肺所致的咳嗽症（C错）。杏苏散适于凉燥伤肺证（D错）。清营汤适于热入营分，伤及营阴的病症（E错）。